能活血祛瘀，利尿消肿的药是
A. 姜黄
B. 丹参
C. 没药
D. 自然铜
E. 益母草

正确答案：E。益母草

解析：本题考查的是益母草的功效。能活血祛瘀，利尿消肿的药是益母草（E对）。益母草：【功效】活血祛瘀，利尿消肿，清热解毒。姜黄（A错）：【功效】破血行气，通经止痛。丹参（B错）：【功效】活血祛瘀，通经止痛，清心除烦，凉血消痈。没药（C错）：【功效】活血止痛，消肿生肌。自然铜（D错）：【功效】散瘀止痛，接骨疗伤。